心肌有效不应期较长的主要作用为
A. 使心肌得到充分休息
B. 使心肌产生“全或无”式收缩
C. 避免心肌发生强直收缩
D. 便于窦房结控制心节律
E. 使心房和心室交替收缩

正确答案：C。避免心肌发生强直收缩

解析：心肌细胞兴奋性的周期变化：有效不应期（绝对不应期+局部反应期）→相对不应期→超常期。由于心肌兴奋性周期的有效不应期特别长，相当于整个收缩期和舒张早期，保证了心肌细胞在收缩期不再接受任何刺激而产生兴奋和收缩，避免心肌发生强直收缩（C对），而始终进行收缩和舒张交替的活动，从而保证心脏泵血功能的正常进行。